医疗机构执业许可证应于校验期满前一定期限内向登记机关申请办理校验手续，该期限是
A. 1个月
B. 半年
C. 15天
D. 3个月
E. 10天

正确答案：D。3个月

解析：医疗机构经执业登记取得《医疗机构执业许可证》后，应当按照规定的期限办理校验手续。医疗机构应当于校验期满前3个月（D对）向登记的卫生行政部门申请办理校验手续，并提交《医疗机构校验申请书》《医疗机构执业许可证》副本等。卫生行政部门应当在受理校验申请后30日内完成校验。